固定义齿修复后存在垂直向食物嵌塞是由于存在过大的
A. 颊侧外展隙
B. 舌外展隙
C. （牙合）外展隙
D. 邻间隙
E. 切外展隙

正确答案：C。（牙合）外展隙

解析：本题考查固定局部义齿修复后可能出现的问题及处理。固定义齿修复后存在垂直向食物嵌塞是由于存在过大的（牙合）外展隙（C对）。垂直型食物嵌塞是指食物受咬合压力楔入邻间隙中，不易剔除。因此较大的（牙合）外展隙更能引起食物的垂直型嵌塞。在两牙接触区周围均有向四周展开的呈V字形的空隙，称为楔状隙或外展隙。